湿痰的特征是
A. 黄而粘稠，坚而成块
B. 白而清稀
C. 清稀而多泡沫
D. 白滑而量多，易咯
E. 少而粘，难咯

正确答案：D。白滑而量多，易咯

解析：痰白滑量多，易于咯出者，多属湿痰。因脾失健运，水湿内停，湿聚为痰，上犯于肺所致（D对）。痰黄而粘稠，坚而成块者为热痰，因热邪犯肺，煎津为痰，痰聚于肺所致（A错）。痰白清稀者，多属寒痰（B错）。痰清稀而多泡沫者为风痰，多因肝风挟痰，上扰清窍所致（C错）。少而粘，难咯者属燥痰。因燥邪犯肺，耗伤肺津所致（E错）。